下肢静脉曲张行静脉造影显示静脉全程通畅呈直桶状，提示
A. 单纯性下肢静脉曲张
B. 动静脉瘘
C. 交通支瓣膜功能不全
D. 下肢深静脉血栓形成后遗症
E. 原发性下肢深静脉瓣膜功能不全

正确答案：E。原发性下肢深静脉瓣膜功能不全

解析：原发性下肢深静脉瓣膜功能不全（E对）是指深静脉瓣膜不能紧密关闭，引起血液逆流，但无先天性或继发性原因。下肢静脉顺行造影显示下列特点：深静脉全程通畅，明显扩张，瓣膜影模糊或消失，失去正常的竹节状形状形态呈直筒状。单纯性下肢静脉曲张（A错）静脉造影可见下肢浅静脉迂曲扩张。动静脉瘘（P505）（B错）动脉造影常表现为：患肢动脉主干增粗，血流加快；动脉分支增多，紊乱且呈扭曲状。交通支瓣膜功能不全（C错）作下肢深静脉顺行造影，可有下肢浅静脉显影。下肢深静脉血栓形成（P502）（D错）在不同时期作下肢静脉顺行造影可表现为闭塞或中断、充盈缺损、再通、侧支循环形成等征象。